以胸闷太息为辩证要点的是
A. 肝火上炎
B. 肝气郁结
C. 肝阳上亢
D. 肝胆湿热
E. 肝风内动

正确答案：B。肝气郁结

解析：本题考查的是肝气郁结证的临床表现及辨证要点。以胸闷太息为辩证要点的是肝气郁结（B对）。肝气郁结证临床表现，常见胁肋胀痛，胸闷不舒，善太息，神情沉默，不欲饮食，或见口苦善呕，头目眩晕，脉弦，舌苔白滑。肝火上炎（A错）证临床表现，常见头痛眩晕，耳聋耳鸣，面红目赤，口苦，尿黄，甚则咯血、吐血、衄血，舌红苔黄，脉弦数。肝阳上亢（C错）证临床表现，常见头痛、头胀、眩晕，时轻时重，耳鸣耳聋，口燥咽干，两目干涩，失眠健忘，腰膝酸软，舌红少津，脉多弦而有力。肝胆湿热（D错）证临床表现，常见胁肋满闷疼痛，黄疸，小便短赤，或小便黄而浑浊，或带下色黄腥臭，外阴瘙痒，或睾丸肿痛，红肿灼热，舌苔黄腻，脉弦数。肝风内动（E错）证的临床表现及辨证要点，风有内风、外风之分，一般所称肝风，均指内风而言。其症状主要以眩晕抽搐、震颤等为主。